用凉远凉，用温远温，属于
A. 阳虚寒凝
B. 津亏血燥
C. 脾肾两虚
D. 脾胃虚寒
E. 气机壅滞

正确答案：D。脾胃虚寒